某患儿感冒几天后哭闹不安，医生检查见外耳道有脓液流出，诊断为中耳炎，问炎症破坏何结构出现外耳道流脓
A. 鼓室后壁
B. 鼓室下壁
C. 鼓室外侧壁
D. 鼓室前壁
E. 鼓室上壁

正确答案：C。鼓室外侧壁

解析：中耳向外借鼓膜与外耳道相隔，中耳炎导致的流脓可能的是破坏了鼓室外侧壁（C对）。